鼻衄，血色鲜红，口渴欲饮，鼻干，口干臭秽，烦躁，便秘，舌红，苔黄，脉数，其辩证为
A. 肝火犯肺证
B. 阴虚火旺证
C. 烦躁伤肺证
D. 肝火上炎证
E. 胃热炽盛证

正确答案：E。胃热炽盛证

解析：足阳明胃之经脉上交鼻颊，齿龈为阳明经脉所过之处，胃火上炎，热迫血行，则鼻衄，或兼齿衄，血色鲜红；胃火消灼胃津，则口渴欲饮，鼻干，口干臭秽，便秘；胃热扰心，则烦躁；舌红，苔黄，脉数为胃热炽盛之征，故（E对）。肝火犯肺证之咳血的主要临床表现为咳嗽阵作，痰中带血或纯血鲜红，胸胁胀痛，烦躁易怒，口苦等（A错）。阴虚火旺证之齿衄的主要临床表现为齿衄，血色淡红，齿摇不坚，舌质红，苔少，脉细数等（B错）。燥热伤肺证之咳血的主要临床表现为喉痒咳嗽，痰中带血，口干鼻燥，或有身热等（C错）。肝火上炎证之鼻衄的主要临床表现为鼻衄，头痛，目眩，耳鸣，烦躁易怒，两目红赤等（D错）。